女，3岁。被牵拉前臂后，出现肘部疼痛，不愿用手取物，桡骨近端压痛。X线片检查未见骨折征象。最适宜的治疗方法是
A. 肩肘固定带悬挂
B. 外敷药物
C. 石膏固定
D. 手法复位
E. 切开探查

正确答案：D。手法复位

解析：患儿前臂牵拉史，肘部疼痛，活动受限，桡骨近端压痛，X线片检查未见骨折征象，应诊断为桡骨头半脱位。其治疗以手法复位（D对E错）为主，复位后不必固定（AC错），但不可再暴力牵拉，以免复发。外敷药物（B错）对桡骨头半脱位治疗意义不大。